牙隐裂隐裂线不明显时常采用的检查方法
A. 咬诊
B. 电活力检测
C. 碘酊染色
D. 探诊
E. 冷热诊

正确答案：C。碘酊染色

解析：咬诊、探诊、染色法、透照法均可用于隐裂牙的检查。2.5%碘酊或其他染料类药物使牙面裂纹清晰可见。对无症状隐裂牙也能检查出来。掌握“隐裂”知识点。